临床怀疑泌尿系结石，应首选的检查方法是
A. 卧位腹平片
B. 立位腹平片
C. 体层检查
D. 上消化道造影检查
E. 腹部侧位片

正确答案：A。卧位腹平片

解析：临床怀疑泌尿系结石，应首选的检查方法是卧位腹平片。x线腹平片，可以看到大部分的泌尿系结石，对阴性结石，x线可以穿透结石，因而看不到。x线造影，对于可异的输尿管结石，可以判断是结石还是狭窄（A对E错）。立位腹平片是不用引入任何造影而拍摄的腹部照片，当腹部某种脏器因疾病而发生钙化或有不透X线的异物、结石，或腹腔内有游离气体出现，肠腔内气体、液体增多或肠管有扩张时，就会出现密度高低的差别而在照片上显示出来（B错）。体层检查多用于肺隔离症，复发性多软骨炎，成人多囊肾，腰腿痛（C错）。上消化道造影检查是消化道疾病常用的检查方法，是指十二指肠以上部分的消化道造影。上消化道造影检查的部位包括口咽、食管、胃和十二指肠（D错）。